典型流行性脑脊髓膜炎脑脊液的改变是
A. 白细胞增多，蛋白升高，糖含量低
B. 白细胞减少，蛋白升高，糖含量高
C. 白细胞减少，蛋白正常，糖含量正常
D. 白细胞增多，蛋白降低，糖含量高
E. 白细胞增多，蛋白升高，糖含量正常

正确答案：A。白细胞增多，蛋白升高，糖含量低

解析：脑脊液检查是确诊流行性脑脊髓膜炎的重要方法和主要依据。其表现为外观呈米汤样或脓样，白细胞增多，蛋白升高，糖含量低（A对），其中白细胞可达1000×l0⁶/L以上，以中性粒细胞为主，氯化物减低。